花剥苔主病为
A. 脾胃气虚
B. 胃阴不足
C. 胃中热盛
D. 胃气阴两虚
E. 胃阴枯竭

正确答案：D。胃气阴两虚

解析：剥落苔的临床意义是胃气不足，胃阴损伤，或气血两虚；剥苔的范围大小，多与气阴或气血不足程度有关；花剥苔舌苔多处剥脱，舌面仅斑驳残存少量舌苔，程度较重，属于胃气阴两虚（D对）。脾胃气虚表现为舌质淡或胖，苔薄白（A错）。胃阴不足表现为舌红少苔、或有裂纹（B错）。胃中热盛表现为齿龈红肿疼痛，舌红，苔黄（C错）。胃阴枯竭表现为镜面舌，色红绛（E错）。